酸枣仁的功效是
A. 养心安神，通便
B. 养心安神，通络
C. 养心安神，敛汗
D. 养心安神，调经
E. 养心安神，止泻

正确答案：C。养心安神，敛汗